内源性哮喘的临床表现是
A. 多见于儿童与青少年
B. 常于春、秋季发病
C. 可有前驱症状
D. 起病慢，较多见哮喘持续状态
E. 发病急，症状缓解快

正确答案：D。起病慢，较多见哮喘持续状态

解析：内源性哮喘是指非过敏原因引起的哮喘，绝大多是由于呼吸道感染诱发，冬季气候变化时多见（B错），青壮年女性居多（A错）。无前驱症状（C错），发作时虽与外源性哮喘相似，但起病慢，持续时间较久，且逐渐加重（D对E错），顽固性者夜间发作较为多见，待感染控制后才能平息。